关于非必需氨基酸下列哪种说法是错误的
A. 人体不需要的氨基酸
B. 人体内可以合成
C. 不依赖食物的供给
D. 食物中含量丰富
E. 合成机体蛋白质所必需

正确答案：A。人体不需要的氨基酸